8岁患者，跌倒致右上1牙冠斜折，即刻来院就诊。口腔检查见穿髓孔大，叩（+）。首选治疗为活髓切断术，进行这种治疗成功的关键是
A. 盖髓剂的选择
B. 无菌操作
C. 正确的开髓
D. 去除稍多些的健康冠髓
E. 正确选择暂封剂

正确答案：B。无菌操作

解析：首选治疗为活髓切断术，进行这种治疗成功的关键是无菌操作（B对）。年轻恒牙牙髓切断术的主要目的是保存根髓健康活力，促使牙根继续发育，术中应严格按照无菌操作的原则，使用橡皮樟，彻底清除感染的牙髓。